药物增生的牙龈肥大起始于
A. 舌侧龈乳头
B. 腭侧龈乳头
C. 近中龈乳头
D. 远中龈乳头
E. 唇颊侧龈乳头

正确答案：E。唇颊侧龈乳头

解析：本题考查药物性牙龈肥大。药物增生的牙龈肥大起始于唇颊侧龈乳头（E对）。苯妥英钠所致的牙龈增生一般开始于服药后的1～6个月内，增生起始于唇颊侧或舌腭侧龈乳头，呈小球状突起于牙龈表面。继之，增生的龈乳头继续增大而互相靠近或相连并向龈缘扩展，盖住部分牙面，严重时波及附着龈，使牙龈的外观发生明显的变化。